使大脑皮层全面兴奋的中枢神经递质是
A. 5-羟色胺
B. 促肾上腺皮质素
C. 去甲肾上腺素
D. 肾上腺素
E. 血管加压素

正确答案：D。肾上腺素